常用于栓剂基质的水溶性材料是
A. 聚乙烯醇（PVA）
B. 聚乙二醇（PEG）
C. 交联聚维酮（PVPP）
D. 聚乳酸羟乙酸（PLGA）
E. 乙基纤维素（EC）

正确答案：B。聚乙二醇（PEG）

解析：本题考查常用于栓剂基质的水溶性材料。常用于栓剂基质的水溶性材料是聚乙二醇（PEG）（B对）；聚乙烯醇(PVA）（A错）为水溶性包衣材料；交联聚维酮(PVPP）（C错）为崩解剂；聚乳酸羟乙酸(PLGA）（D错）为合成高分子囊材；乙基纤维素（EC）（E错）是水不溶性包衣材料。